膀胱肿瘤与结核好发于
A. 输尿管间襞
B. 膀胱体
C. 膀胱垂
D. 膀胱颈
E. 膀胱三角

正确答案：E。膀胱三角

解析：膀胱三角是膀胱底内面的三角形区域，是肿瘤、结核和炎症的好发部位（E对）。